根据《处方管理办法》，下列叙述正确的有
A. 药师应当对处方用药选用剂型与给药途径的合理性进行审核
B. 药师对于不规范处方或者不能判定其合法性的处方，不得调剂
C. 中成药和中药饮片可以分别开具处方，也可以开具一张处方
D. 药师应当认真逐项检查处方前记、正文和后记书写是否清晰、完整，并确认处方的合法性
E. 医疗机构购进同一通用名称药品的品种，口服剂型不得超过三种

正确答案：A、B、D。药师应当对处方用药选用剂型与给药途径的合理性进行审核；药师对于不规范处方或者不能判定其合法性的处方，不得调剂；药师应当认真逐项检查处方前记、正文和后记书写是否清晰、完整，并确认处方的合法性

解析：本题考查处方管理。根据《处方管理办法》，下列叙述正确的有药师应当对处方用药选用剂型与给药途径的合理性进行审核（A对）；药师对于不规范处方或者不能判定其合法性的处方，不得调剂（B对）；药师应当认真逐项检查处方前记、正文和后记书写是否清晰、完整，并确认处方的合法性（D对）。《处方管理办法》第五章处方的调剂第三十四条：药师应当认真逐项检查处方前记、正文和后记书写是否清晰、完整，并确认处方的合法性。第三十五条：药师应当对处方用药适宜性进行审核，审核内容包括：（一）规定必须做皮试的药品，处方医师是否注明过敏试验及结果的判定；（二）处方用药与临床诊断的相符性；（三）剂量、用法的正确性；（四）选用剂型与给药途径的合理性；（五）是否有重复给药现象；（六）是否有潜在临床意义的药物相互作用和配伍禁忌；（七）其他用药不适宜情况。第四十条：药师对于不规范处方或者不能判定其合法性的处方，不得调剂。《处方管理办法》第二章处方管理的一般规定第六条：处方书写应当符合下列规则：（一）患者一般情况、临床诊断填写清晰、完整，并与病历记载相一致。（二）每张处方限于一名患者的用药。（三）字迹清楚，不得涂改；如需修改，应当在修改处签名并注明修改日期。（四）药品名称应当使用规范的中文名称书写，没有中文名称的可以使用规范的英文名称书写；医疗机构或者医师、药师不得自行编制药品缩写名称或者使用代号；书写药品名称、剂量、规格、用法、用量要准确规范，药品用法可用规范的中文、英文、拉丁文或者缩写体书写，但不得使用“遵医嘱”“自用”等含糊不清字句。（五）患者年龄应当填写实足年龄，新生儿、婴幼儿写日、月龄，必要时要注明体重。（六）西药和中成药可以分别开具处方，也可以开具一张处方，中药饮片应当单独开具处方（C错）。（七）开具西药、中成药处方，每一种药品应当另起一行，每张处方不得超过5种药品。（八）中药饮片处方的书写，一般应当按照“君、臣、佐、使”的顺序排列；调剂、煎煮的特殊要求注明在药品右上方，并加括号，如布包、先煎、后下等；对饮片的产地、炮制有特殊要求的，应当在药品名称之前写明。（九）药品用法用量应当按照药品说明书规定的常规用法用量使用，特殊情况需要超剂量使用时，应当注明原因并再次签名。（十）除特殊情况外，应当注明临床诊断。（十一）开具处方后的空白处划一斜线以示处方完毕。（十二）处方医师的签名式样和专用签章应当与院内药学部门留样备查的式样相一致，不得任意改动，否则应当重新登记留样备案。《处方管理办法》第四章处方的开具第十六条：医疗机构应当按照经药品监督管理部门批准并公布的药品通用名称购进药品。同一通用名称药品的品种，注射剂型和口服剂型各不得超过2种（E错），处方组成类同的复方制剂1～2种。因特殊诊疗需要使用其他剂型和剂量规格药品的情况除外。